女性，3个月，口腔舌面满布白屑，面赤唇红，烦躁不宁，吮乳啼哭，大便干结，小便短黄。治疗首选
A. 导赤散
B. 清胃散
C. 清热泻脾散
D. 泻黄散
E. 六味地黄丸

正确答案：C。清热泻脾散

解析：胎热内蕴，传于胎儿；或口腔不洁，感受秽毒之邪，致心脾积热。邪热循 经上乘，熏灼口舌则发为本病。清热泻脾散清脾泄热。治疗小儿心脾蕴热，致患鹅口，白屑生满口舌，如鹅之口者（C对）。疱疹性口炎心火上炎证症状：心火上炎舌窍故见舌上、舌边溃烂，色赤疼痛；心火炽盛，热扰心神故见烦躁多啼；热盛伤津故见口干欲饮，小便短黄；火热内盛故见舌尖红，苔薄黄，脉数，指纹紫滞。治法：清心凉血，泻火解毒。方药：泻心导赤散加减（A错）。清胃散具有清脏腑热，清胃凉血之功效。主治胃火牙痛（B错）。泻黄散泻脾胃伏火，治疗脾胃伏火证，目疮口臭，烦渴易饥，口燥唇干，舌红脉数，以及脾热弄舌等（D错）。六味地黄丸具有滋阴补肾的功效。用于肾阴亏损，头晕耳鸣，腰膝酸软，骨蒸潮热，盗汗遗精（E错）。